慢性支气管炎的诊断标准是
A. 有咳嗽、咳痰症状，每年发病持续3个月
B. 有咳嗽、咳痰症状，每年发病2个月，连续3年以上
C. 有咳嗽、咳痰伴喘息症状，每年发作持续3个月，连续4年以上
D. 有咳嗽、咳痰伴喘息症状，每年发病持续3个月，连续3年以上，除外其他心、肺疾患
E. 有咳嗽、咳痰症状，每年发病持续3个月，连续2年或2年以上，并除外其他心、肺疾患

正确答案：E。有咳嗽、咳痰症状，每年发病持续3个月，连续2年或2年以上，并除外其他心、肺疾患

解析：本题考查慢性支气管炎的诊断标准。慢性支气管炎的诊断标准是有咳嗽、咳痰症状，每年发病持续3个月，连续2年或2年以上，并除外其他心、肺疾患（E对ABCD错）。